丹参酮ⅡA属于
A. 苯醌
B. 萘醌
C. 菲醌
D. 蒽醌
E. 三萜

正确答案：C。菲醌

解析：本题考查的是丹参酮ⅡA分类。丹参酮ⅡA属于菲醌（C对）。丹参的化学成分主要包括脂溶性成分和水溶性成分两大部分。脂溶性成分大多为共轭醌、酮类化合物。如丹参酮Ⅰ、丹参酮ⅡA、丹参酮ⅡB、隐丹参酮等。《中国药典》采用高效液相色谱法测定丹参中丹参酮类和丹酚酸B的含量，要求丹参酮ⅡA、隐丹参酮和丹参酮Ⅰ的总量不得少于0.25%，丹酚酸B不得少于3.0%。另外，水溶性成分则包括丹参素，丹参酸A、丹酚酸B，原儿茶酸，原儿茶醛等。醌类化合物从结构上分主要有苯醌、萘醌、菲醌、蒽醌等四类。1.苯醌（A错）类：苯醌类化合物从结构上可分为邻苯醌和对苯醌两大类。从中药软紫草中分得的一些物质属于对苯醌类化合物。2.萘醌（B错）类：许多萘醌类化合物具有明显的生物活性，如从中药紫草及软紫草中分得的一系列紫草素及异紫草素衍生物，可认为这些萘醌化合物为紫草的有效素成分。3.菲醌类：天然菲醌类衍生物包括邻醌及对醌两种类型。如从中药丹参根中提取的丹参醌Ⅰ、丹参醌ⅡA、丹参醌ⅡB、隐丹参醌等。4.蒽醌（D错）类：蒽醌类成分包括蒽酮及其不同还原程度的产物。按母核可分为单蒽核及双蒽核，按氧化程度又可分为氧化蒽酚、蒽酮、蒽酚及蒽酮的二聚物。三萜（E错）是由6个异戊二烯单位衍生而成，不属于醌类化合物。